下列何结构不属于特异性中继核团
A. 中线核
B. 腹后内侧核
C. 腹后外侧核
D. 腹外侧核
E. 腹前核

正确答案：A。中线核

解析：特异性中继核团包括腹前核（E对）、腹外侧核（D对）和腹后核，腹后核又含腹后内侧核（B对）和腹后外侧核（C对），而中线核（A错，为本题正确答案）属于非特异性投射核团。